结构类型为环烯萜类化合物的是
A. 龙胆苦苷
B. 青蒿素
C. 莪术醇
D. 桂皮醛
E. 穿心莲酯

正确答案：A。龙胆苦苷

解析：本题考查的是龙胆的有效成分。结构类型为环烯萜类化合物的是龙胆苦苷（A对）。龙胆含有的主要有效成分为裂环环烯醚萜苷类化合物，如獐牙菜苷、獐牙菜苦苷和龙胆苦苷等。青蒿中的主要成分及其化学结构，青蒿所含萜类化合物有蒿酮、异蒿酮、桉油精、樟脑等单萜，青蒿素（B错）、青蒿甲素、青蒿乙素、青蒿丙素及青蒿酸等倍半萜。莪术中的主要化学成分及其结构，吉马酮、莪术醇（C错）、莪术二醇、莪术酮及莪术二酮等为倍半萜类化合物，是莪术挥发油的主要有效成分。芳香族化合物挥发油中的芳香族化合物多为小分子的苯丙素类衍生物，在挥发油中所占比例次于萜类，且多为酚性化合物或其酯类，如桂皮中有解热镇痛作用的桂皮醛（D错）。穿心莲叶中含有多种二萜内酯及二萜内酯苷类成分，如穿心莲内酯（E错）、新穿心莲内酯、14-去氧穿心莲内酯、脱水穿心莲内酯等。